具有温肺化痰功效的药物是
A. 白芥子
B. 紫苏子
C. 葶苈子
D. 杏仁
E. 旋覆花

正确答案：A。白芥子

解析：白芥子辛散温通，气锐走窜，专入肺经。既温肺脏、豁寒痰、利气机，又通经络、散寒结、止疼痛。善治寒痰及痰饮诸证，尤以痰在皮里膜外及经络者最宜（A对）。紫苏子（B错）功效降气化痰，止咳平喘，润肠通便。葶苈子（C错）功效泻肺平喘，行水消肿。杏仁（D错）功效降气止咳平喘，润肠通便。旋覆花（E错）功效降气，消痰，行水，止呕。